诱导免疫耐受的方法是
A. 切除成年动物的胸腺
B. 切除成年动物的脾脏
C. 注射佐剂
D. 注射极大量Ag
E. 注射有丝分裂素和Ag

正确答案：D。注射极大量Ag